尖牙窝一般位于
A. 上颌尖牙根尖的上方
B. 上颌前磨牙根尖的上方
C. 上颌第一磨牙根尖的上方
D. 上颌第二磨牙根尖的上方
E. 上颌侧切牙根尖的上方

正确答案：B。上颌前磨牙根尖的上方

解析：上颌体前外面有眶下孔、尖牙窝，眶下孔位于眶下缘中点下方约0.5cm处，孔内有眶下神经、血管通过，是眶下神经阻滞麻醉的有效注射部位，眶下孔向后、上、外方通入眶下管，尖牙窝一般位于前磨牙根尖的上方。掌握“上颌骨解剖特点”知识点。